属于第二代的抗精神病药物有
A. 氯丙嗪
B. 阿立哌唑
C. 奋乃静
D. 氯氮平
E. 利培酮

正确答案：B、D、E。阿立哌唑；氯氮平；利培酮

解析：本题考查抗精神病药物的分类。属于第二代的抗精神病药物有阿立哌唑（B对）、氯氮平（D对）、利培酮（E对）。目前临床应用的抗精神病药物主要分为两代，氯丙嗪（A错）、奋乃静（C错）为第一代抗精神病药物。